癫痫大发作合并小发作选用
A. 乙琥胺
B. 苯妥英钠
C. 丙戊酸钠
D. 苯巴比妥
E. 卡马西平

正确答案：C。丙戊酸钠

解析：本题考查丙戊酸钠。丙戊酸钠（C对）对人的各型癫痫如对各型小发作、肌阵挛性癫痫、局限性发作、大发作和混合型癫痫均有效。乙琥胺（A错）为癫痫小发作首选药。苯妥英钠（B错）为大发作和局限性发作的首选。苯巴比妥（D错）治疗癫痫大发作和癫痫持续状态，对局限性发作也有效，但不作为首选。卡马西平（E错）为广谱的抗癫痫药，为单纯性局限发作和大发作的首选药物之一。